导致龋齿的最主要食物因素是
A. 碳水化合物
B. 脂肪
C. 蛋白质
D. 矿物质
E. 维生素

正确答案：A。碳水化合物